李某为某医学院专科毕业生，他可以
A. 在医疗、预防、保健机构中试用期满一年，参加执业医师资格考试
B. 在医疗、预防、保健机构中试用期满一年，参加执业助理医师资格考试
C. 在医疗、预防、保健机构中试用期满两年，参加执业助理医师资格考试
D. 取得执业助理医师执业证书后，在医疗、预防、保健机构中工作满一年，参加执业医师资格考试
E. 取得执业助理医师执业证书后，在医疗、预防、保健机构中试用期满一年，参加执业医师资格考试

正确答案：B。在医疗、预防、保健机构中试用期满一年，参加执业助理医师资格考试